成牙骨质细胞瘤的好发部位是
A. 下颌前磨牙或磨牙区
B. 上颌前磨牙或磨牙区
C. 下颌切牙区
D. 上颌切牙区
E. 下颌尖牙区

正确答案：A。下颌前磨牙或磨牙区

解析：成牙骨质细胞瘤多发生在10～29岁男性下颌前磨牙或磨牙区。掌握“牙源性黏液瘤、成牙骨质细胞瘤”知识点。